下面哪项不是急性疱疹性口炎与疱疹样口疮的区别
A. 好发年龄不同
B. 性别差异
C. 前者为急性发作、全身反应较重；后者为反复发作、全身反应较轻
D. 前者病损表现为成簇小水疱；后者病损表现为散在小溃疡
E. 前者病损可伴皮肤损害；后者病损无皮肤损害

正确答案：B。性别差异

解析：口疮在临床上多见，最常见的是轻型，溃疡为圆形或椭圆形，数目一般较少亦较表浅，故不留瘢痕，若有感染则溃疡扩大且加深，但这种情况少见。重型往往有轻型的病史，多为1～2个大而深的溃疡或同时有1～2个较小的溃疡。病程长，疗效差。疱疹样口疮，溃疡小而数目多，散在分布呈口炎形式。周围黏膜充血，这与疱疹性口炎常难以区别。疱疹性口炎与疱疹样口疮无明显的性别差异。掌握“口腔单纯疱疹”知识点。